《素问·上古天真论》“筋骨坚，发长极，身体盛壮”，是女子哪个年龄段的表现
A. "二七"
B. "三七"
C. "四七"
D. "五七"
E. "六七"

正确答案：C。"四七"

解析：《素问·上古天真论》记述了肾气由稚嫩到充盛，由充盛到衰少继而耗竭的演变过程，说：“女子七岁，肾气盛，齿更发长。二七而天癸至，任脉通，太冲脉盛，月事以时下，故有子（A错）。三七，肾气平均，故真牙生而长极（B错）。四七，筋骨坚，发长极，身体盛壮（C对）。五七，阳明脉衰，面始焦，发始堕（D错）。六七，三阳脉衰于上，面皆焦，发始白（E错）。七七，任脉虚，太冲脉衰少，天癸竭，地道不通，故形坏而无子也”。